关于水痘-带状疱疹病毒，以下正确的说法是
A. 攻击T淋巴细胞
B. 侵犯三叉神经
C. 导致黏膜下纤维性变
D. 感染后血清抗体滴度低
E. 增加他病毒感染机会

正确答案：B。侵犯三叉神经

解析：本题考查带状疱疹。水痘-带状疱疹由水痘-带状疱疹病毒所引起的，以沿单侧周围神经分布的簇集性小水疱为特征的口腔黏膜感染性疾病。多累计腰部胸腹部神经，其次累及三叉神经（B对）。老年人多罹患三叉神经。攻击T淋巴细胞（A错）引起的疾病多为超敏反应性疾病。黏膜下纤维性变（C错）是一种慢性进行性具有癌变倾向的口腔黏膜疾病，临床上常表现为口干、灼痛、进刺激性食物疼痛、进行性张口受限、吞咽困难等症状。带状疱疹病毒感染后，血清抗病毒抗体滴度升高（D错），2～3周后达到高峰。增加其他病毒感染机会（E错）多在机体功能减退、免疫力降低情况下发生。